女，35岁。腹胀、便秘、乏力6个月。1周来症状加重伴呕吐。查体：T37.6℃，右腹可触及5cm×3cm大小包块，质中等，边界不清，轻触痛。胸片示右侧胸膜肥厚，右上肺钙化灶。首先考虑的临床诊断是
A. 右侧卵巢肿物
B. 肠结核
C. 结肠癌
D. 克罗恩病
E. 阑尾周围脓肿

正确答案：B。肠结核

解析：青年女性患者，腹胀、便秘、乏力，T37.6℃（37.3～38℃为低热），右下腹可触及一包块，轻触痛，胸片示右侧胸膜肥厚，右上肺钙化灶（提示肺结核），肠结核常继发于肺结核，表现出全身性结核症状，为增生型肠结核，表现为低位不完全性肠梗阻，腹部可见肠型，肠鸣音高亢，右下腹常可触及固定、较硬且有压痛的肿块，患者表现较为典型，X片也显示肺结核灶，结合患者病史、体查和影像学表现，应首先考虑肠结核（B对）。肠结核常继发于肺结核，一般见于中青年，根据病理特点可分为溃疡型和增生型两种，临床以腹痛、大便习惯改变、腹部肿块及低热、盗汗、乏力等全身症状为主要表现，溃疡型常伴腹泻，增生型常有便秘。卵巢肿物（A错）主要表现为腹部局限性肿块，一般无全身症状，侵犯胃肠道时可引起消化系统症状。结肠癌（C错）多见于中老年人，常见的临床表现有腹痛、腹泻、便秘、便中带血及腹部肿块，肿块质硬，呈结节状，活动度差。克罗恩病（D错）多侵犯回肠末段，常起病缓慢，主要表现为腹泻、腹痛、体重下降，粪便多为糊状，一般无脓血和黏液，腹痛常位于右下腹，可伴有关节、皮肤、眼口腔黏膜等肠外损害。阑尾周围脓肿（E错）多继发于急性阑尾炎化脓坏疽或穿孔后，前期可有阑尾炎的典型表现。